原发性肝癌最常见的组织学类型是
A. 未分化癌
B. 胆管上皮癌
C. 肝细胞癌
D. 类癌
E. 混合型肝癌

正确答案：C。肝细胞癌

解析：原发性肝癌根据组织学类型可分为肝细胞肝癌、胆管细胞癌（B错）和混合型肝癌（E错），其中以肝细胞肝癌（C对）最为多见，约占原发性肝癌的90%。未分化癌（A错）、类癌（D错）不属于原发性肝癌的组织学分型。